常规根管治疗术的步骤为
A. 根管冲洗、预备和充填
B. 根管消毒和充填
C. 根管预备和充填
D. 根管预备、消毒和充填
E. 根管冲洗、消毒和充填

正确答案：D。根管预备、消毒和充填

解析：根管治疗术由根管预备、根管消毒和根管充填三大步骤组成。掌握“根管清理与成形”知识点。